有首过效应，并需要舌下含服的药物是
A. 美托洛尔
B. 单硝酸异山梨酯
C. 瑞舒伐他汀
D. 福辛普利
E. 硝酸甘油

正确答案：E。硝酸甘油

解析：本题考查首过效应。硝酸甘油（E对）口服有首过效应，舌下含服吸收迅速完全，应舌下含服。